分子中含有苯并咪唑结构，通过抑制H⁺/K⁺-ATP酶产生抗溃疡作用的药物有
A. 西咪替丁
B. 法莫替丁
C. 兰索拉唑
D. 盐酸雷尼替丁
E. 雷贝拉唑

正确答案：C、E。兰索拉唑；雷贝拉唑

解析：本题考查质子泵抑制剂抗溃疡药。兰索拉唑（C对）和雷贝拉唑（E对）属于质子泵抑制剂，分子中含有苯并咪唑结构，通过抑制H⁺/K⁺-ATP酶产生抗溃疡作用。西咪替丁（A错）、法莫替丁（B错）、盐酸雷尼替丁（D错）均属于H₂受体阻断剂类抗溃疡药物。